圆形图各部分构成比之和等于
A. 2
B. 0
C. 4
D. 3
E. 1

正确答案：E。1

解析：本题考查统计图。圆形图各部分构成比之和等于1（E对）。圆形图各部分构成比之和等于1，整个圆用来表示整体。